化学物引起的超敏反应包括四型，不正确的是
A. 速发型反应
B. 迟发型反应
C. 自身免疫反应
D. 免疫复合物型反应
E. 细胞毒型反应

正确答案：C。自身免疫反应